苯二氮䓬类药物的催眠作用机制是
A. 与GABAA受体亚单位结合
B. 增强GABA能神经传递和突触抑制
C. 与β亚单位苯二氮草受体结合
D. 促进GABA的释放
E. 减慢GABA的降解

正确答案：B。增强GABA能神经传递和突触抑制

解析：GABA是神经元膜上的配体－门控氯离子通道，在氯离子通道周围有含有5个结合位点，其中包括苯二氮䓬类受点，苯二氮䓬类的催眠作用机制主要是与GABA的苯二氮䓬类受点结合，配体受体复合物诱导受体构象变化，促进二者紧密结合，增加氯离子通道开放频率，氯离子大量内流引起膜超极化，从而增强GABA能神经传递和突触后抑制（B对），使神经元兴奋性降低，产生中枢抑制效应，从而明显缩短入睡时间、显著延长睡眠时间、减少觉醒次数。